右纤维三角位于
A. 主动脉后瓣环和二尖瓣环、三尖瓣环之间
B. 主动脉后瓣环和三尖瓣环之间
C. 主动脉后瓣环和二尖瓣环之间
D. 肺动脉后瓣环和三尖瓣环之间
E. 肺动脉后瓣环和三尖瓣环之间

正确答案：A。主动脉后瓣环和二尖瓣环、三尖瓣环之间

解析：右纤维三角位于主动脉后瓣环和二尖辦环、三尖瓣环之间（A对）。